可分泌胃蛋白酶原的主要细胞是
A. 肥大细胞
B. 壁细胞
C. 黏液细胞
D. 杯状细胞
E. 主细胞

正确答案：E。主细胞

解析：主细胞（E对）合成和分泌胃蛋白酶原。肥大细胞（A错）主要分泌组胺。壁细胞（P185）（B错）合成和分泌盐酸和内因子。黏液细胞（P185）（C错）主要分泌碱性粘液，贲门腺和幽门腺的黏液细胞也可分泌胃蛋白酶原，但不是分泌胃蛋白酶原的主要细胞。杯状细胞（D错）主要分泌大肠液。